卡托普利可以特异性抑制的酶
A. 单胺氧化酶
B. 胆碱酯酶
C. 甲状腺过氧化物酶
D. 黏肽代谢酶
E. 血管紧张素转化酶

正确答案：E。血管紧张素转化酶

解析：本题考查卡托普利。卡托普利通过抑制血管紧张素转化酶（E对）的活性，抑制血管紧张素Ⅰ转换成血管紧张素Ⅱ，扩张血管，降低血压。苯乙肼等为单胺氧化酶抑制剂（A错）。新斯的明为胆碱酯酶（B错）抑制剂。丙硫氧嘧啶抑制过氧化酶系统（C错），使被摄入到甲状腺细胞内的碘化物不能氧化成活性碘。青霉素类抗菌药物能够干扰细菌细胞壁黏肽的合成（D错）。